脑膜炎双球菌有不同的菌群，目前我国流行的菌群以下列哪群为主
A. A群
B. B群
C. C群
D. D群
E. E群

正确答案：A。A群